女，30岁。反复腹痛、腹泻10年。排便后腹痛可缓解，无发热、消瘦。多次查粪常规示软便或粘液便，镜检（-），隐血（-）。最可能的诊断是
A. 克罗恩病
B. 肠结核
C. 溃疡性结肠炎
D. 慢性细菌性痢疾
E. 肠易激综合征

正确答案：E。肠易激综合征

解析：中年女性患者，反复腹痛、腹泻10年（病程6个月以上），排便后腹痛可缓解（符合肠易激综合征的腹痛特点），无发热、消瘦。多次查粪常规示软便或黏液便（粪便性状异常），镜检（-），隐血（-）（肠易激综合征为功能性胃肠病，镜检阴性）。综合该患者的病史、实验室检查，考虑诊断为肠易激综合征（E对）。克罗恩病（P377）（A错）临床以腹痛、腹泻、体重下降、腹块、瘘管形成和肠梗阻为特点，可伴有发热等全身表现。肠结核（P368）（B错）多有低热、盗汗等结核毒血症状。溃疡性结肠炎（P374）（C错）多有黏液脓血便，粪隐血试验阳性。慢性细菌性痢疾（D错）多有黏液脓血便，粪检（+），隐血（+）。